舌苔黄腻，脉濡数。其证候是
A. 脾虚
B. 肾阳虚
C. 肾阴虚
D. 湿热
E. 热毒

正确答案：D。湿热

解析：根据症状描述，患者因为湿热蕴结于下，损伤任带二脉，故带下量多，色黄有臭气；湿热内盛，阻于中焦，则口苦口腻，胸闷纳呆；舌苔黄腻，脉濡数为湿热之征，故其证候是湿热证（D对）。脾虚证主要有带下量多，色白或淡黄，质稀薄，绵绵不断，无臭，并伴有面色晄白或萎黄，四肢倦怠，纳少便溏，或四肢浮肿；舌淡胖，苔白而腻，脉细缓等证候表现（A错）。肾阳虚证除带下量多，绵绵不断，质清稀如水，还有腰酸如折，畏寒肢冷，小便清长，夜尿多；舌质淡，苔白润，脉沉迟等证候表现（B错）。肾阴虚证主要有带下量多，色黄或赤白相兼，质稠，有气味，阴部瘙痒，腰酸腿软，头晕耳鸣，五心烦热，咽干口燥，或烘热汗出，失眠多梦；舌质红，苔少或黄腻，脉细数等证候表现（C错）。热毒证主要有带下量多，黄绿如脓，或赤白相兼，或五色杂下，质黏腻，臭秽难闻；小腹疼痛，腰骶酸痛，烦热头晕，口苦咽干，小便短赤，大便赤结；舌红，太黄或黄腻，脉滑数等证候表现（E错）。